男，72岁。进行性排尿困难6年，近1周出现排尿疼痛伴发热，T39度。B超提示前列腺增大，残余尿400ml，双肾积水。尿常规：WBC30～50/HP。血BUN及Scr升高。入院后首选的治疗是
A. 耻骨上膀胱造瘘+抗感染治疗
B. α受体阻滞剂
C. 5α还原酶抑制剂
D. 前列腺切除
E. 抗感染治疗

正确答案：A。耻骨上膀胱造瘘+抗感染治疗

解析：老年男性患者，进行性排尿困难，B超提示前列腺增大，残余尿量400ml，结合患者病史、临床表现和相关检查，该患者最可能的诊断为前列腺增生。患者发热，T39度（高于正常值36～37度），尿常规：WBC30～50/HP（高于正常值0～5/HP），提示合并尿路感染；血BUN及Scr升高，提示肾功能不全，而且患者双肾积水，因此首选的治疗是耻骨上膀胱造瘘引流积水，保护积水肾功能，同时行抗感染治疗（A对E错），待上述病情明显改善后再行手术治疗（D错）。α受体阻滞剂（B错）、5α还原酶抑制剂（C错）适用于症状较轻、前列腺增生体积较小的病人。